适用于学校物质环境评价指标的是
A. 学生卫生知识的及格率
B. 学生人均病假日数
C. 学校教室照度的卫生标准
D. 学校家长对学校的满意度
E. 学生的心理健康指导

正确答案：C。学校教室照度的卫生标准